咳声重浊，痰稀色白为
A. 风寒
B. 痰湿
C. 燥热
D. 脾虚
E. 肺气虚

正确答案：A。风寒

解析：咳声重浊，痰稀色白，多因风寒袭肺，肺失宣降（A对）。寒痰湿浊停聚于肺，肺失肃降故咳声重浊沉闷，多属实证（B错）。燥热邪犯肺，灼伤肺津所以咳嗽声高响亮，痰少黏稠色黄，不易咯出（C错）。脾气虚证，脾气不足，运化失职，以纳少、腹胀、便溏及气虚症状为主要表现（D错）。肺气虚，失于宣降，则咳声轻清低微，多属虚证（E错）。